男，60岁。近1周来指关节等多处关节疼痛。门诊化验血尿酸为0.5mmol/L，诊断为痛风，服用别嘌呤醇后缓解。该患者体内主要的代谢障碍途径是
A. 嘧啶核苷酸代谢
B. 嘌呤核苷酸代谢
C. 葡萄糖代谢
D. 脂肪酸代谢
E. 丙氨酸代谢

正确答案：B。嘌呤核苷酸代谢